创伤性休克时
A. 内源性凝血系统被激活
B. 外源性凝血系统被激活
C. 两者均有
D. 两者均无
E. 无

正确答案：C。两者均有

解析：创伤性休克时内源性凝血系统被激活和外源性凝血系统被激活（AB对，C为本题正确答案）。外源性凝血系统被激活是严重的创伤导致的组织损伤等等情况下，可释放大量组织因子入血，激活外源性凝血系统，启动凝血过程。内源性凝血系统被激活也可出现在创伤性休克时。